下述各项，对诊断葡萄胎的价值最大的是
A. 出现卵巢黄素化囊肿
B. 妊娠试验
C. 盆腔B超诊断
D. 子宫大于孕月
E. 停经后阴道出血

正确答案：C。盆腔B超诊断

解析：盆腔B超诊断为目前最常用而又较准确的诊断方法，应用最多的有下列两种∶B超检查∶子宫内呈“落雪状”影像，是完全性葡萄胎的典型表现；部分性葡萄胎在上述影像中还可见胎囊或胎儿。超声多普勒探测胎心：正常妊娠最早在孕6周时可探测到胎心音，孕12周后阳性率达 100%，在葡萄胎则只能探测到子宫血流杂音（C对）；葡萄胎患者往往可以出现卵巢黄素化囊肿，大量hCG刺激卵巢卵泡内膜细胞，发生黄素化而形成，卵巢黄素化囊肿常在葡萄胎清宫术后2-4个月自行的消失，部分性葡萄胎表现较完全性葡萄胎症状较为轻（A错）；妊娠试验可用于早期妊娠诊断、观察异常妊娠及与妊娠有关的情况、监测保胎治疗的效果、监测先兆流产的治疗效果以及葡萄胎、恶性葡萄胎、绒毛膜癌及睾丸畸胎瘤的患者，尿中HCG显著增高（B错）；子宫大于孕月，可能是正常生理性的，多是由于个体差异的原因；但也有可能是病理性的，如葡萄胎，多数患者的子宫大于相应的停经月份的妊娠子宫（D错）；停经后阴道出血的原因有很多，可能是同房后出血、宫内节育器损伤、妇科疾病等（E错）。